属于天然高分子微囊囊材的有
A. 乙基纤维素
B. 明胶
C. 阿拉伯胶
D. 聚乳酸
E. 壳聚糖

正确答案：B、C、E。明胶；阿拉伯胶；壳聚糖

解析：本题考查药物微囊化的材料。常用的囊材可分为天然的、半合成或合成的高分子材料三大类：（1）天然高分子囊材：明胶（B对）、阿拉伯胶（C对）、海藻酸盐、壳聚糖（E对）。（2）半合成高分子囊材：羧甲基纤维素盐、醋酸纤维素酞酸酯（CAP）、乙基纤维素（EC）（A错）、甲基纤维素（MC）、羟丙甲纤维素（HPMC）。（3）合成高分子囊材：聚碳酯、聚氨基酸、聚乳酸（PLA）（D错） 、丙交酯乙交酯共聚物、聚乳酸-聚乙二醇嵌段共聚物等。